下述哪项不是毛状白斑的病理表现
A. 上皮钉突肥厚，伸长
B. 棘细胞增生
C. 棘细胞内出现角化细胞或角化珠
D. 棘细胞气球样变
E. 过度不全角化形成刺状突起

正确答案：C。棘细胞内出现角化细胞或角化珠

解析：本题考查艾滋病的口腔表征-口腔毛状白班。棘细胞内出现角化细胞或角化珠（C错，为本题的正确答案）不是毛状白斑的病理表现。鳞状细胞癌镜下：鳞状上皮增生，侵入结缔组织内，为蟹足状；癌细胞呈团块或条索状排列，称为癌巢；癌巢的外周细胞相当于基底细胞，中心部分可出现层状的角化物称为角化珠。毛状白斑是发生于口腔黏膜的白色绒毛状病变，病理表现为上皮钉突肥厚伸长（A对），棘细胞增生（B对），棘细胞气球样变（D对）以及过度不全角化形成刺状突起（E对）。